见肝之病，知肝传脾的病机传变是
A. 木克土
B. 木乘土
C. 土侮木
D. 母病及子
E. 子病犯母

正确答案：B。木乘土

解析：本题考查五行生克乘侮理论，属理解内容。“见肝之病，知肝传脾”，肝的病变可影响到脾的功能的发挥，故应先实脾，预防疾病的传变。如肝气太过，或郁结，或上逆，木亢则乘土（B对），病将及脾胃，此时应在疏肝平肝的基础上预先培其脾气，使肝气得平，使脾气得健，则肝病不得传于脾。